环磷酰胺抗肿瘤作用特点是
A. 在休内外均有活性
B. 在体内代谢为醛磷酰胺后有抗肿瘤作用
C. 在体外有抑杀癌细胞作用
D. 干扰转录过程
E. 干扰有丝分裂

正确答案：B。在体内代谢为醛磷酰胺后有抗肿瘤作用